有关乳糜池的说法，正确的是
A. 通常位于第2～3腰椎前方
B. 由左、右腰干和左、右肠干汇合而成
C. 多为胸导管起始部的膨大
D. 由左、右肠干和腰干汇合而成
E. 乳糜池中的淋巴液澄清透明

正确答案：C。多为胸导管起始部的膨大

解析：乳糜池位于第一腰椎前方（A错），呈囊状膨大，是胸导管起始处（C对），由左右腰干和肠干汇合而成（BD错），自乳糜池到胸导管淋巴管道中淋巴液因含乳糜微粒呈白色（E错）。